下列各项，不属六淫共同致病特点的是
A. 季节性
B. 相兼性
C. 外感性
D. 流行性
E. 地域性

正确答案：D。流行性

解析：疠气是有别于六淫而具有强烈传染性的外感病邪，流行性强（D错，为本题正确答案）、发病急、一气一病是其致病特点。六淫，即风、寒、暑、湿、燥'、火（热）是外感病因之一，他们的共同致病特点为外感性（C对）、地域性（E对）、季节性（A对）、相兼性（B对）。